为了解黄体功能进行诊刮的时间应选在
A. 月经来潮后6小时内
B. 月经期2—3日
C. 月经期5—6日
D. 月经干净3—7日
E. 月经干净10-14日

正确答案：A。月经来潮后6小时内

解析：判断有无排卵或黄体功能不良，在月经前或月经来潮6小时内刮宫（A对）；IUD取器时间在月经干净后3-7日为宜；疑为子宫内膜不规则脱落时，应于月经第5-6日取材。